关于奥美拉唑，哪一项是错误的
A. 是目前抑制胃酸分泌作用最强的
B. 抑制胃壁细胞H+泵作用
C. 也能使促胃液素分泌增加
D. 是H2受体阻断药
E. 对消化性溃疡和反流性食管炎效果好

正确答案：D。是H2受体阻断药

解析：奥美拉唑为质子泵抑制剂，即PPI，不是H2受体拮抗剂。掌握“奥美拉唑”知识点。